下列学校预防艾滋病健康教育，错误的核心信息是
A. 艾滋病正在世界各国蔓延
B. 我国已经进入艾滋病快速蔓延增长阶段
C. 青少年是艾滋病的易感人群
D. 女青少年尤其对艾滋病敏感
E. 迄今为止，还没有找到可根治艾滋病的药物，但已经成功研制出预防艾滋病的疫苗

正确答案：E。迄今为止，还没有找到可根治艾滋病的药物，但已经成功研制出预防艾滋病的疫苗